传导躯体、四肢浅感觉传导路的纤维交叉部位位于
A. 脊髓
B. 延髓
C. 脑桥
D. 中脑
E. 间脑

正确答案：A。脊髓

解析：传导躯体、四肢浅感觉传导路的第二级神经元在脊髓发出纤维交叉至对侧，组成脊髓（A对）丘脑侧束和脊髓丘脑前束。